对体液免疫起辅助作用
A. Tc
B. Treg
C. Th
D. Th1
E. Th2

正确答案：E。Th2